观察舌苔以辨别病邪深浅，主要依据是
A. 舌苔的有无
B. 舌苔的厚薄
C. 舌苔的颜色
D. 舌苔的真假
E. 舌苔的润燥

正确答案：B。舌苔的厚薄

解析：舌苔的薄厚主要反映了邪正的盛衰和邪气的深浅（B对）。薄苔，多见于疾病初起，病邪在表；厚苔多主邪盛入里，或内有痰饮食积。舌苔的有无即舌苔的剥落情况，根据舌苔剥落的部位和范围大小的不同，可分为前剥、中剥、根剥、花剥、地图舌、镜面舌、类剥苔等；主胃气不足、胃阴损伤，或气血两虚（A错）。苔色的变化主要有白苔、黄苔、灰黑苔三类，临床既可单独出现，亦可相兼出现。各种苔色变化需要参照苔质、舌色、舌形及舌态变化进行综合分析（C错）。真、假苔对辨别疾病的轻重、预后有重要意义（D错）。润、燥苔主要反映津液的盈亏和输布情况（E错）。